女婴，8个月，发热，烦躁1天，T38.7℃，P105次/分，R35次/分，BP80/62mmHg，神差，呼吸急促，左肺底可闻及湿啰音，心音低钝，腹膨隆，四肢皮温低，可见大理石纹。WBC19×10⁹/L，N0.8，X线左下肺片状影，问休克类型是
A. 心源性休克
B. 感染性休克
C. 神经源性休克
D. 低血容量性休克
E. 过敏性休克

正确答案：B。感染性休克

解析：8个月患儿，发热烦躁，T38.7℃（﹥38℃），P105次/分（﹥90次/分），R35次/分（﹥20次／分），白细胞计数﹥12x10⁹ /L，诊断为SIRS；BP80/62mmHg（﹤30mmHg），神差，呼吸急促，左肺底可闻及湿啰音，心音低钝，腹膨隆，四肢皮温低，可见大理石纹（低动力型感染性休克的临床表现），根据临床表现和实验室检查诊断为低动力型感染性休克（B对）。心源性休克：由于心肌受损，急性心包炎心包填塞及严重心律失常（心房颤动或心室颤动）引起心脏泵衰竭，因而出现心排血量明显降低，有效循环血量和灌注血流量下降，而最终发生休克（A错）。神经源性休克：由于剧烈的神经刺激引起血管活性物质释放，是动脉调节功能障碍，导致外周血管扩张，有效循环血量减少引发的休克。常见于外伤所致的剧痛、脊髓损伤、药物麻醉等（C错）。低血容量性休克：因大量失血或大量体液丢失而出现血容量骤然减少，回心血量不足，为低血容量性休克（D错）。包括失血性休克、创伤性休克。过敏性休克：由于抗原进入被致敏的机体内与相应抗体结合后发生行变态反应，血管活性物质释放，导致全身的毛细血管扩张，通透性增加，血浆渗出到组织间隙，致使循环血量迅速减少引发电休克（E错）。